直接免疫荧光染色技术，可见黏膜病变部位的上皮基底膜区域有免疫球蛋白及补体沉淀，呈翠绿色的网状荧光带，为以上哪种疾病
A. 天疱疮
B. 白斑
C. 扁平苔藓
D. 红斑
E. 良性黏膜类天疱疮

正确答案：E。良性黏膜类天疱疮

解析：良性黏膜类天疱疮采用直接免疫荧光染色技术，可见黏膜病变部位的上皮基底膜区域有免疫球蛋白及补体沉淀，呈均匀连续的线状荧光带，为抗基底膜抗体阳性，为特异性诊断标志。掌握“口腔黏膜下纤维化与天疱疮，类天疱疮”知识点。